哪种毒物中毒的血液中可查到赫恩氏小体
A. 苯中毒
B. 苯胺中毒
C. 甲苯中毒
D. 二甲苯中毒
E. 甲醇中毒

正确答案：B。苯胺中毒

解析：本题考查赫恩滋小体的形成。苯胺（B对ACDE错）的主要毒性作用是其中间代谢产物苯胲，它有很强的形成高铁血红蛋白的能力。它能造成机体组织缺氧，引起中枢神经系统、心血管系统及其他脏器的一系列损伤，同时还能使红细胞内的珠蛋白变性形成赫恩滋小体。